关于网膜孔的叙述错误的是
A. 约在第12胸椎至第2腰椎体的前方
B. 位于小网膜右缘的前方
C. 成人可容1~2指
D. 经此孔可进人网膜囊
E. 无

正确答案：B。位于小网膜右缘的前方

解析：网膜孔约在第12胸椎至第2腰椎体的前方（A对）,成人可容纳1-2指（C对）,经此孔可进入网膜囊（D对），网膜孔位于小网膜的右缘后方（B错，为本题正确答案）。